6岁，女孩。出生后反复呼吸道感染，平时少活动。体检：无发绀，心前区稍隆起，胸骨左缘3～4肋间Ⅲ级粗糙全收缩期杂音，伴震颤，P₂轻度亢进。该病血流动力学改变首先引起
A. 右心室增大
B. 左心室增大
C. 左心房增大
D. 主动脉扩张
E. 肺动脉扩张

正确答案：B。左心室增大

解析：患儿体检无发绀，P₂轻度亢进，诊断在室间隔缺损的最初阶段，左心室部分血液流入右心室，导致体循环血量减少，左心室做功增加，最终导致左心室增大（B对A错）。大型缺损者以右心室增大为主。室间隔缺损以心室改变为主，心房基本无改变（C错）。主动脉扩张性疾病（D错）可分为真性动脉瘤、主动脉夹层和假性动脉瘤，无胸骨左缘3-4肋间Ⅲ级粗糙全收缩期杂音。肺动脉扩张（E错）体检示心浊音界不增大，肺动脉瓣区有3级以下的收缩期吹风样杂音和收缩喷射音、第2心音分裂并略亢进。